易导致牙齿黄染的药品是
A. 庆大霉素
B. 加替沙星
C. 多西环素
D. 头孢哌酮
E. 阿莫西林

正确答案：C。多西环素

解析：本题考查多西环素。多西环素（C对）是四环素类，能与钙或镁离子形成不溶性的钙盐或镁盐，导致牙齿变黄。加替沙星（B错）不良反应为血糖紊乱。庆大霉素（A错）不良反应是耳毒性，血压下降。头孢哌酮（D错）不良反应是双硫仑样反应。阿莫西林（E错）不良反应是过敏反应。